根据中医体质学说偏阴者多见
A. 畏寒
B. 舌红
C. 畏热
D. 喜动
E. 急躁

正确答案：A。畏寒

解析：本题考查的是偏阴质的体质特征。根据中医体质学说偏阴者多见畏寒（A对）。人体正常体质大致可分为阴阳平和质、偏阳质、偏阴质三种类型。1.阴阳平和质：是指强健壮实、功能比较协调的体质类型。体质特征为：身体强壮，胖瘦适度，体形匀称健壮；面色与肤色虽有五色之偏，但都红黄隐隐，明润含蓄，头发稠密有光泽；鼻色明润，嗅觉通利；食量适中，二便调畅；目光有神，性格开朗、随和；夜眠安和，精力充沛，反应灵活，思维敏捷，能耐寒暑，自身调节和对外适应能力强；唇色红润，舌质淡红、润泽，苔薄白，脉象缓匀有神。2.偏阳质：是指具有代谢相对亢奋、身体偏热、多动、易兴奋等特性的体质类型。体质特征为：形体适中或偏瘦，但较结实；面色多略偏红或微苍黑，或呈油性皮肤，皮肤易生疮疖；食量较大，消化吸收功能健旺，大便易干燥，小便易黄赤；平素畏热（C错）喜冷，耐冬不耐夏，或体温略偏高；动则易出汗，口渴喜冷饮；精力旺盛，动作敏捷，反应灵敏，性欲较强，喜动（D错）好强；性格外向，易急躁（E错）；唇、舌偏红（B错），苔薄易黄，脉象多数或细弦。3.偏阴质：是指具有代谢相对减退、身体偏寒、喜静少动等特征的体质类型。体质特征为：形体适中或偏胖，但肌肉不壮；面色偏白而欠华，口唇色淡；毛发易落；食量较小，消化吸收功能一般；平时畏寒喜热，手足不温，耐夏不耐冬，或体温偏低；大便溏薄，小便清长；精力偏弱，容易疲劳，睡眠偏多；动作迟缓，反应较慢，喜静少动，性欲偏弱；性格内向，或胆小易惊；舌质偏淡，脉多迟缓。